色谱系统适用性试验的项目有
A. 拖尾因子
B. 理论塔板数
C. 检测限
D. 定量限
E. 分离度

正确答案：A、B、E。拖尾因子；理论塔板数；分离度